男性，35岁。右下一后牙龋坏3年，充填物反复脱落。检查：46牙冠远中及舌侧大面积龋坏缺损，叩痛（-），无松动，临床冠较长。X线片示根管治疗完善，根长及牙槽骨高度正常。该患者最适合的修复方式是
A. 嵌体
B. 全瓷冠
C. 金属全冠
D. 金属烤瓷全冠
E. 桩核金属烤瓷冠

正确答案：E。桩核金属烤瓷冠

解析：患牙根管治疗后，牙冠远中及舌侧大面积缺损，缺损范围大，牙冠剩余牙体组织强度差，直接采用全冠修复时冠部牙体组织的抗力不足，更不能采用嵌体修复。正确的修复方法是，去除牙冠部分薄弱的牙体组织，进行桩核金属烤瓷冠修复。掌握“牙体缺损修复体固位及适应、禁忌证”知识点。